自中药乙醇提取浓缩液中分离总皂苷可选用的方法是
A. Et₂O沉淀法
B. 胆甾醇沉淀法
C. 铅盐沉淀法
D. 吉拉尔试剂提取法
E. 碱水提取法

正确答案：A。Et₂O沉淀法

解析：本题考查的是水提醇沉法和醇提水沉法。自中药乙醇提取浓缩液中分离总皂苷可选用的方法是Et₂O沉淀法（A对）。Et₂O即乙醚。水提醇沉法和醇提水沉法：这两种方法是利用两种以上不同溶剂的极性和溶解性差异进行分离。在溶液中加入另一种溶剂以改变混合溶剂的极性，使一部分物质沉淀析出，从而实现分离。常见如在药材浓缩水提取液中加入数倍量高浓度乙醇，以沉淀除去多糖、蛋白质等水溶性杂质达到分离的目的称为水提醇沉法（也称水/醇法）。在浓缩乙醇提取液中加入数倍量水稀释，放置以沉淀除去树脂、叶绿素等水不溶性杂质达到分离目的的方法称为醇提水沉法（醇/水法）等。同理，在乙醇浓缩液中加入数倍量乙醚（醇/醚法）或丙酮（醇/丙酮法），可使皂苷沉淀析出，而脂溶性的树脂等类杂质则留存在母液中，也是分离常用的方法之一。铅盐沉淀法（C错）可除去鞣质。铅盐法：在中药的水提取液中加入饱和的乙酸铅或碱式乙酸铅溶液，可使鞣质沉淀而被除去，然后按常规方法除去滤液中过剩的铅盐。胆甾醇沉淀法（B错）、吉拉尔试剂提取法（D错）与碱水提取法（E错），2022年考试指南未明确说明。